黄某，65周岁。在某医疗机构治疗过程中，因为医疗事故而致残。依据《医疗事故处理条例》的规定，赔偿其残疾生活补助费的时间不应超过
A. 5年
B. 10年
C. 15年
D. 20年
E. 30年

正确答案：C。15年

解析：依据《医疗事故处理条例》的第五十条的第五点残疾生活补助费：按照医疗事故发生地居民年平均生活费计算，自定残之月起最长赔偿30年；但是，60周岁以上的，不超过15年（C对）；70周岁以上的，不超过5年。